《难经》关于命门的论点是
A. 左肾右命门说
B. 两肾总号命门说
C. "七节之旁，中有小心"说
D. "命门者，目也"说
E. 命门为"水火之宅"说

正确答案：A。左肾右命门说

解析：《难经·三十九难》：“肾两者，非皆肾也，其左为肾，右为命门”（A对）。虞抟，《医学正传·医学或问》：“两肾总号为命门”（B错）。“七节之旁，中有小心”（C错）为赵献可《医贯》引用《内经》中原文。“命门者，目也”（D错）出自《灵枢·根结》。命门为“水火之宅”（E错）出自《景岳全书》。